与四氢硼钠试剂反应呈阳性的是
A. 二糖
B. 三糖
C. 二氢黄酮
D. 单糖
E. 多糖

正确答案：C。二氢黄酮

解析：本题考查二氢黄酮的显色反应。与四氢硼钠试剂反应呈阳性的是二氢黄酮（C对）。四氢硼钠（钾）反应：在黄酮类化合物中，NaBH4，对二氢黄酮类化合物专属性较高，可与二氢黄酮类化合物反应产生红色至紫色。其他黄酮类化合物均不显色，可与之区别。方法是在试管中加入0.1ml含有样品的乙醇液，再加等量2%NaBH4的甲醇液，1分钟后，加浓盐酸或浓硫酸数滴，变成紫色至紫红色。苷类化合物由苷元和糖两部分组成，故苷类化合物能发生相应的苷元和糖的各种显色反应。苷元的结构多种多样。糖的显色反应中最重要的是Molish反应，常用的试剂由浓硫酸和α-萘酚组成。硫酸兼有水解苷键的作用，生成的单糖（D错）在浓硫酸的作用下，失去三分子水，生成具有呋喃环结构的醛类化合物。由五碳糖生成的是糠醛，甲基五碳糖生成的是5-甲糠醛，六碳糖生成的是5-羟甲糠醛。这些糠醛衍生物和许多芳胺、酚类可缩合成有色物质，可借此来检识糖和苷类化合物的存在。